在完整的动物机体建立条件反射的关键步骤是
A. 存在无关刺激
B. 没有干扰刺激
C. 存在非条件刺激
D. 无关刺激与非条件刺激在时间上多次结合
E. 非条件刺激出现在无关刺激之前

正确答案：D。无关刺激与非条件刺激在时间上多次结合